传统中药丸剂所包药物系用处方中药物极细粉作为包衣材料，根据处方：清热解毒中药丸剂常包
A. 朱砂衣
B. 黄柏衣
C. 雄黄衣
D. 青黛衣
E. 赭石衣

正确答案：D。青黛衣

解析：本题考查的是药物衣的作用。传统中药丸剂所包药物系用处方中药物极细粉作为包衣材料，根据处方：清热解毒中药丸剂常包青黛衣（D对）。药物衣：包衣材料是处方药物制成的极细粉，本身具有一定的药理作用，用于包衣既可首先发挥药效，又可保护丸粒、增加美观。常见的药物衣有朱砂衣（A错）（镇静、安神、补心类药物常用）、黄柏衣（B错）（利湿、渗水、清下焦湿热的药物常用）、雄黄衣（C错）（解毒、杀虫类药物常用）、青黛衣（清热解毒类药物常用）、百草霜衣（清热解毒类药物常用）等。药物的赭石衣（E错），2022年考试指南未明确说明。